有关足底弓的组成的描述，正确的是
A. 由足底内侧动脉和足底外侧动脉组成
B. 由足底内侧动脉与足背动脉末支组成
C. 由足底外侧动脉与足背动脉的足底深支组成
D. 由足底内侧动脉穿支与足背动脉末支组成
E. 由足底外侧动脉的浅支与深支组成

正确答案：C。由足底外侧动脉与足背动脉的足底深支组成

解析：由足底外侧动脉与足背动脉的足底深支吻合形成足底弓（C对），由弓上发出4支跖足底总动脉，后者又各发出2支趾足底固有动脉，分布于足趾。